关于非处方药专有标识管理要求的说法，错误的有
A. 非处方药药品标签、说明书和各级销售包装单元包装印有通用名称的一面，其左上角是非处方药专有标识的固定位置
B. 非处方药专有标识印刷时，标识下方必须标示“甲类”或者“乙类”字样
C. 非处方药专有标识图案分别为绿色和红色，分别对应甲类非处方药和乙类非处方药
D. 非处方药专有标识图案为水平短轴椭圆背景下的“OTC”3个英文字母的组合

正确答案：A、B、C、D。非处方药药品标签、说明书和各级销售包装单元包装印有通用名称的一面，其左上角是非处方药专有标识的固定位置；非处方药专有标识印刷时，标识下方必须标示“甲类”或者“乙类”字样；非处方药专有标识图案分别为绿色和红色，分别对应甲类非处方药和乙类非处方药；非处方药专有标识图案为水平短轴椭圆背景下的“OTC”3个英文字母的组合

解析：本题考查的是非处方药专有标识的管理。关于非处方药专有标识管理要求的说法，错误的有非处方药药品标签、说明书和各级销售包装单元包装印有通用名称的一面，其左上角是非处方药专有标识的固定位置（A错，为本题正确答案）、非处方药专有标识印刷时，标识下方必须标示“甲类”或者“乙类”字样（B错，为本题正确答案）、非处方药专有标识图案分别为绿色和红色，分别对应甲类非处方药和乙类非处方药（C错，为本题正确答案）。非处方药专有标识图案分为红色和绿色，红色专有标识用于甲类非处方药品，绿色专有标识用于乙类非处方药品和用作指南性标志。使用非处方药专有标识时，药品的使用说明书和大包装可以单色印刷，标签和其他包装必须按照国家药品监督管理部门公布的色标要求印刷。单色印刷时，非处方药专有标识下方必须标示“甲类”或“乙类”字样”。非处方药药品标签、使用说明书和每个销售基本单元包装印有中文药品通用名称（商品名称）的一面（侧），其右上角是非处方药专有标识的固定位置。非处方药专有标识图案为水平长轴椭圆背景下的“OTC”3个英文字母的组合（D错，为本题正确答案）。